心力衰竭患者常规联合用药的种类有
A. 肾素-血管紧张素-醛固酮系统抑制剂
B. 醛固酮受体阻断剂
C. β受体阻断剂
D. α受体阻断剂
E. 钙通道阻滞剂

正确答案：A、B、C。肾素-血管紧张素-醛固酮系统抑制剂；醛固酮受体阻断剂；β受体阻断剂

解析：本题考查药物的联合应用。心力衰竭患者常规联合用药的种类有：肾素-血管紧张素-醛固酮系统抑制剂（A对）、醛固酮受体阻断剂（B对）、β受体阻断剂（C对）。α受体阻断剂（D错）与钙通道阻滞剂（E错）不用于心力衰竭。